氯丙嗪引起的血压下降不能用哪种药纠正
A. 甲氧明
B. 肾上腺素
C. 去氧肾上腺素
D. 去甲肾上腺素
E. 间羟胺

正确答案：B。肾上腺素